男孩，14岁。发热、腹泻5小时，9小时前同学聚餐，5小时前开始发热、腹泻，体温39.2℃，伴畏寒，无明显寒战，呕吐初为胃内容物。查体：T39℃，P100次/分，R20次/分，双肺呼吸音粗，未闻及干湿性啰音，心律齐，腹软，下腹部有轻微压痛，无肌紧张、反跳痛。粪镜检WBC20～30/HP，RBC4～8/HP，吞噬细胞1～2/HP。最可能的诊断是
A. 消化功能紊乱
B. 急性肠胃炎
C. 急性细菌性痢疾
D. 轮状胃肠炎
E. 产毒性大肠埃希菌肠炎

正确答案：C。急性细菌性痢疾

解析：青少年男性患者，9小时前同学聚会（致病菌经手、苍蝇、食物和水经口感染可能性大），5小时前开始发热，体温可达39.2℃、畏寒、腹泻（急性感染症状）、呕吐胃内容物，查体下腹部有轻微压痛（急性菌痢普通型可有体征），粪便镜检可见WBC20～30/HP（≥15个/高倍视野），吞噬细胞1～2/HP，根据体征和实验室检查可能诊断为急性细菌性痢疾。消化系统功能紊乱（功能性消化不良）（A错）是指由胃和十二指肠功能紊乱引起的症状，而无器质性疾病的一组临床综合征，主要表现包括餐后饱胀、上腹胀痛、上腹灼热感、嗳气、食欲不振、恶心等，诊断该疾病需排除可解释症状的器质性病变，该患者粪镜检异常，提示有器质性病变，不能诊断为消化系统功能紊乱（八版内科学P398）。急性胃肠炎（B错）起病较急，有恶心、呕吐、腹痛、腹泻等症状，腹痛以上、中腹持续或阵发性绞痛多见，腹泻轻重不一，多为黄色稀便、水样便或黏液便。轮状胃肠炎（儿科学P256）（D错）是婴儿腹泻最常见的病原，潜伏期1～3天，多发生在6～24月龄婴幼儿。起病急，多先吐后泻，伴轻、中度发热。腹泻每日十到数十次不等，大便多为黄色水样或呈蛋花样便带少量黏液，无腥臭，粪镜检偶可见少量白细胞。产毒性大肠埃希菌肠炎（E错）（P167）由肠毒素性大肠埃希菌感染引起，是旅游者腹泻的最重要的病原，为分泌性腹泻，往往急性起病，典型者突起剧烈腹痛、水样便，数天后出现血性便，很少发热。病情轻重不等，可以仅有轻微腹泻，也可呈重症霍乱样。